由苏敬等人编著的药典性本草是
A. 《本草纲目》
B. 《新修本草》
C. 《证类本草》
D. 《神农本草经》
E. 《本草纲目拾遗》

正确答案：B。《新修本草》